即使结核菌对其已产生耐药，但复治时仍可选用的药物是
A. 利福平
B. 异烟肼
C. 链霉素
D. 乙胺丁醇
E. 吡嗪酰胺

正确答案：B。异烟肼